标本涂片镜检可见圆形或卵圆形菌体，革兰染色阳性，从菌体上有芽管伸出，但不与菌体脱离，形成假菌丝；将标本接种至玉米粉培养基上，可长出厚膜孢子，此微生物可能是
A. 葡萄球菌
B. 链球菌
C. 白色念珠菌
D. 放线菌
E. 毛癣菌

正确答案：C。白色念珠菌